香豆素类灭鼠药中毒的特效解毒剂是
A. 维生素K₁
B. 乙酰胺
C. 硫酸阿托品
D. 氯解磷定
E. 烟酰胺

正确答案：A。维生素K₁

解析：本题考查香豆素类灭鼠药中毒解救。香豆素类灭鼠药中毒的特效解毒剂是维生素K₁（A对）。香豆素类灭鼠药中毒的特效解毒剂：静脉滴注维生素K₁10～30mg, 一日1～3次；亦可先静脉注射维生素K₁50mg ，然后改为10～20mg肌内注射，一日1～4次。乙酰胺（B错）为有机氟杀虫剂农药中毒的特效解毒剂。硫酸阿托品（C错）、氯解磷定（D错）为有机磷农药中毒的解毒剂。烟酰胺（E错）是敌枯双农药中毒的特效解毒剂。